男，55岁。饮酒及高脂饮食后突发上腹疼痛4小时，向背部放射，伴呕吐、大汗、尿色黄。对诊断最有帮助的辅助检查是
A. 上消化道X线钡餐
B. 腹部CT
C. 肝胆核素扫描
D. 立位腹部x线平片
E. 胃镜

正确答案：B。腹部CT

解析：患者中年男性，饮酒及高脂饮食后突发上腹疼痛4小时，向背部放射，伴呕吐、大汗、尿色黄（饮酒及高脂饮食后突发上腹部疼痛且向腰背部放射为急性胰腺炎的典型症状，常伴恶心、呕吐）。根据患者的病史、症状，可考虑诊断为急性胰腺炎。对于急性胰腺炎的最有诊断价值的影像学检查为腹部CT（B对）。上消化道X线钡餐（A错）是经过吞食硫酸钡后，通过钡剂在经食道到达胃、十二指肠部位的显影过程来进行上消化道疾病的诊断方法，通常用于无法耐受胃镜时。肝胆核素扫描（P435）（C错）主要用于胆道疾病的检查。立位X线腹部平片（P480）（D错）可协助了解横隔的高低，有无隔下游离气体，肠梗阻时腹部立位平片可以了解肠道气液平和肠袢分布，但对急性胰腺炎的诊断帮助不大。胃镜（E错）主要用于食管、胃、十二指肠疾病的检查及治疗。